哮喘伴有心功能不全宜选用
A. 氨茶碱
B. 沙丁胺醇
C. 倍氯米松
D. 异丙肾上腺素
E. 色甘酸钠

正确答案：A。氨茶碱

解析：本题考查氨茶碱。哮喘伴有心功能不全宜选用氨茶碱（A对）。氨茶碱为黄嘌呤类平喘药，具有松弛气道平滑肌、呼吸兴奋、强心等作用，适用于慢性喘息的治疗和预防，辅助治疗急性哮喘、急性心功能不全和心源性哮喘，但急性心肌梗死伴血压显著降低患者禁用。沙丁胺醇（B错）用于治疗支气管哮喘或喘息性慢性支气管炎伴支气管痉挛。倍氯米松（C错）用于持续性哮喘的长期治
疗。异丙肾上腺素（D错）支气管哮喘及心脏房室传导阻滞。色甘酸钠（E错）属于肥大细胞膜稳定剂，是一种抗过敏药，用于治疗过敏性哮喘。